影响地表水水体自净过程的重要因素是
A. 气象条件
B. 水体流速
C. 季节变化
D. 自然地貌
E. 温度变化

正确答案：B。水体流速

解析：本题考查影响地表水水体自净过程的重要因素。水体自净是指水体受污染启污染物在水体的物理、化学和生物学作用下，使污染成分不断稀释、扩散、分解破坏或沉入水底，水中污染物浓度逐渐降低，水质最终又恢复到污染前的状况。影响地表水水体自净过程的因素有很多，重要的因素是水体的流动速度（B对ACDE错）。